女，65岁。外阴瘙痒五年，近两个月伴局部疼痛，阴蒂右侧部位可见直径约2.5cm的肿物，活检组织病理学诊断为鳞状细胞癌。正确的处理是
A. 外阴单纯局部切除术
B. 外阴扩大局部切除术
C. 外阴扩大局部切除术+单侧腹股沟淋巴结清扫术
D. 外阴广泛切除术+单侧腹股沟淋巴结清扫术
E. 外阴广泛切除术+双侧腹股沟淋巴结清扫术

正确答案：D。外阴广泛切除术+单侧腹股沟淋巴结清扫术

解析：患者外阴瘙痒，疼痛，阴蒂右侧部位见直径约2.5cm的肿物（肿瘤最大径线＞2cm或间质浸润＞1.0mm，局限于外阴或会阴，无淋巴结转移），活检组织病理学诊断为鳞状细胞癌，提示患者为外阴鳞状细胞癌ⅠB期。外阴癌ⅠB期，手术方式为外阴根治术+单侧腹股沟淋巴结清扫术（D对）。